印度博帕尔市的农药厂泄漏毒气事件是世界上最大的大气污染急性中毒事件，该厂泄漏的毒气是
A. 二氧化硫和飘尘
B. 光化学烟雾
C. 过氧乙酰基硝酸酯
D. 甲基异氰酸甲酯
E. 放射性毒物

正确答案：D。甲基异氰酸甲酯